下列腧穴中，治疗便秘效果较好的是
A. 关冲
B. 中渚
C. 支沟
D. 外关
E. 阳池

正确答案：C。支沟

解析：四个选项均是手少阳三焦经穴，关冲为井穴、中渚为输穴、阳池为原穴、支沟为经穴、外关为络穴，八脉交会穴，通于阳维脉。支沟穴，“支”的含义是树枝的分叉的状态，“沟”的含义是沟渠，“支沟”的含义是指三焦经气血在此穴位像分叉的树枝一样扩散，另支沟穴是经穴，在五行属火，具有通经开窍、活络散瘀、调理脏腑的功能，常用于治疗耳鸣、耳聋、呕吐、便秘（C对）、热病、肩酸背痛等症。其它四个穴位无直接治疗便秘的功效（ABDE错）。